义齿修复前骨尖修整的最佳时机是拔牙后
A. 2周左右
B. 4周左右
C. 8周左右
D. 10周左右
E. 12周左右

正确答案：B。4周左右

解析：本题考查骨尖修整的最佳时机。义齿修复前骨尖修整的最佳时机是拔牙后4周左右（B对）。进行牙槽骨修整术去除过突的骨尖或骨突的时间一般在拔牙后1个月左右（ACDE错）。